垂体窝位于
A. 筛骨上面
B. 额骨眶部上面
C. 蝶骨体上面
D. 颞骨岩部上面
E. 均不对

正确答案：C。蝶骨体上面

解析：中央为蝶骨体，其上面有垂体窝，窝前外侧为视神经管（C对）。